不属于拔牙的禁忌证的是
A. 不稳定的心绞痛
B. 充血性心力衰竭
C. 未控制的心律不齐
D. 未控制的高血压
E. 2年内发生过心肌梗死

正确答案：E。2年内发生过心肌梗死

解析：下列情况应视为拔牙的禁忌证：①6个月内发生过心肌梗死；②不稳定的或最近才开始的心绞痛；③充血性心力衰竭；④未控制的心律不齐；⑤未控制的高血压。掌握“牙拔除的适应证与禁忌证”知识点。